男，50岁，高血压5年。规律服用培哚普利、美托洛尔和阿司匹林治疗，无胸痛，查体无异常。实验室检查：血TC3.8mmol/L.LDL-C2.0mmol/L，TG5.9mmol/L，HDL-C0.9mmol/L，首选的降脂药物是
A. 依折麦布
B. 考来烯胺
C. 普罗布考
D. 非诺贝特
E. 阿托伐他汀

正确答案：D。非诺贝特

解析：中年男性患者，实验室检查：血TC3.8mmol/L（正常值＜5.20mmol/L），LDL-C2.0mmol/L（正常值≦3.4mmol/L），TG5.9mmol/L（正常0.56-1.70mmol/L），HDL-C0.9mmol/L（正常值1.03-2.07mmol/L）。非诺贝特（D对）是贝特类调脂药，适用于高TG血症和以TG升高为主的混合型高脂血症。依折麦布（A错）适用于高胆固醇血症和以TC升高为主的混合型高脂血症，单药或与他汀类联合使用。考来烯胺（B错）适用于高胆固醇血症和以TC升高为主的混合型高脂血症。普罗布考（C错）适用于高胆固醇血症，纯合子型家族性高胆固醇血症（HoFH）和黄色素瘤病人。阿托伐他汀（E错）是他汀类调脂药，适用于高胆固醇血症。